传染病流行过程的基本条件是
A. 病原体、人体和它们所处的环境
B. 病原体、感菌动物、易感人群
C. 传染源、传播途径、人群易感性
D. 传染源传播过程
E. 社会环节、自然环节

正确答案：C。传染源、传播途径、人群易感性

解析：传染病流行过程的基本条件是传染源、传播途径、人群易感性。掌握“传染病总论”知识点。